治疗急性肾功能衰竭的药物是
A. 螺内酯
B. 甘露醇
C. 氨苯蝶啶
D. 阿米洛利
E. 呋塞米

正确答案：E。呋塞米

解析：本题考查利尿药的临床应用。治疗急性肾功能衰竭的药物是呋塞米（E对）。呋塞米的临床应用：1.消除各种严重水肿；2.治疗急性肺水肿和脑水肿；3.预防急性肾衰竭；4.加速中毒药物排泄。
螺内酯（A错）的临床应用：1.与醛固酮升高有关的顽固性水肿；2.充血性心力衰竭；3.高血压；4.低钾血症的预防。甘露醇（B错）的临床应用：1.预防急性肾衰竭；2.脑水肿及青光眼。氨苯蝶啶（C错）在临床上用于治疗各种水肿，常与排钾利尿药合用治疗顽固性水肿。阿米洛利（D错）临床用于治疗充血性心力衰竭、肝硬化腹水和肾病综合征等水肿性疾病以及肾上腺糖皮质激素治疗过程中发生的水钠潴留。